桔梗具有的功效是
A. 温肺祛痰
B. 降气止呕
C. 开宣肺气
D. 燥湿化痰
E. 利气宽中

正确答案：C。开宣肺气

解析：该题考查的是桔梗的功效，属记忆内容。桔梗苦、辛、平。归肺经。具有宣肺，祛痰，利咽，排脓的功效。（C对）